两侧下颌突未联合，则形成
A. 腭裂
B. 上颌裂
C. 下颌裂
D. 上唇裂
E. 牙槽突裂

正确答案：C。下颌裂

解析：本题考查腭部与舌的发育。下颌裂（C对）为两侧下颌突未联合或部分联合的结果。